根据《药品注册管理办法》，境外生产的药品在中国境内上市销售的注册申请属于
A. 仿制药申请
B. 再注册申请
C. 进口药品申请
D. 补充申请

正确答案：C。进口药品申请

解析：本题考查药品注册申请。进口药品申请（C对），是指在境外生产的药品在中国境内上市销售的注册申请。再注册申请（B错）是指药品批准证明文件有效期满后申请人拟继续生产或者进口该药品的注册申请。进口分包装的药品也应当执行进口药品注册标准。补充申请（D错），是指新药申请、仿制药申请或者进口药品申请经批准后，改变、增加或者取消原批准事项或者内容的注册申请。